不属于氟喹诺酮类药物的药理学特性的是
A. 抗菌谱广
B. 口服吸收好
C. 与其他抗菌药物无交叉耐药性
D. 不良反应较多
E. 体内分布较广

正确答案：D。不良反应较多